无中枢镇静作用的H₁-受体阻滞药是
A. 苯海拉明
B. 异丙嗪
C. 阿司咪唑
D. 曲吡那敏
E. 氯苯那敏

正确答案：C。阿司咪唑